严重贫血引起心力衰竭的主要机制是
A. 心肌能量生成障碍
B. 心肌能量利用障碍
C. 兴奋-收缩耦联障碍
D. 心肌收缩蛋白破坏
E. 心肌能量储存障碍

正确答案：A。心肌能量生成障碍

解析：心脏是一个高耗氧的器官，其能量生成主要依赖于心肌的血液供应。严重贫血时，供血供氧减少，导致心肌能量生成障碍（A对）。